孕35周初孕妇，先兆子痫，患者突发腹痛，4小时后胎心消失，宫底明显升高，子宫强硬，有压痛，宫缩间歇子宫不完全放松，重度贫血貌，阴道少量流血，宫口开1指，头先露，下列何项处理最佳
A. 人工破膜后药物引产
B. 滴注催产素
C. 注射哌替啶调整宫缩
D. 急诊剖宫产术
E. 宫口开全后行穿颅术

正确答案：D。急诊剖宫产术

解析：孕35周初孕妇，先兆子痫（胎盘早剥的常见病因），患者突发腹痛，4小时后胎心消失，宫底明显升高，子宫强硬，有压痛，宫缩间歇子宫不完全放松，重度贫血貌（提示休克），阴道少量流血（胎盘早剥的典型临床表现），宫口开1指，头先露，根据产妇的病史、临床症状及体征，考虑最可能的诊断为胎盘早剥III级，所以应采取急诊剖宫产术（D对），人工破膜后药物引产（A错）适用于0-1级患者，一般情况良好，病情较轻，宫口已扩张，估计短时间内可结束分娩者。